上颌第一磨牙的外形高点与接触区叙述不正确的是
A. 颊面外形高点位于颈1/3处
B. 舌面外形高点位于舌中1/3处
C. 邻面外形高点位于（牙合）1/3处
D. 近中接触区位于（牙合）1/3与颊1/3交界处
E. 近中接触区位于（牙合）1/3与颊1/3、中1/3交界处

正确答案：D。近中接触区位于（牙合）1/3与颊1/3交界处

解析：本题考查上下颌磨牙的外形及临床应用解剖。上颌第一磨牙颊面的外形高点在颈1/3处（A对），舌面外形高点在舌中1/3处（B对），邻面外形高点在（牙合）1/3处（C对），远中接触区在近（牙合）1/3的中1/3处，近中接触区位于（牙合）1/3与颊1/3、中1/3交界处（E对D错，D为本题正确答案）。